某药物在体内按一级动力学消除，如果K=0.0346h⁻¹，该药物的消除半衰期约为
A. 3.46h
B. 6.92h
C. 12h
D. 20h
E. 24h

正确答案：D。20h

解析：本题考查半衰期的计算。药物的生物半衰期是指药物在体内的量或血药浓度消除一半所需要的时间，常以t1/2表示，根据公式：t1/2=0.693/k计算，t1/2=0.693/k=0.693/0.0346h⁻¹=20h（D对）。